男，60岁，排尿等待，尿线变细，尿频6个月，夜尿2-3次，无尿痛，尿常规正常，血清总PSA1.7ng/ml，B超提示前列腺体积增大，膀胱剩余尿10ml，以下治疗能够马上缓解急性症状的是
A. 口服5α还原酶抑制剂
B. 经尿道前列腺切除
C. 耻骨上前列腺切除
D. 抗感染治疗
E. 口服α受体拮抗剂

正确答案：B。经尿道前列腺切除

解析：老年男性患者，尿线变细，尿频，夜尿增多，超声提示前列腺体积增大，血清PSA 1.7ng/ml（血清前列腺特异性抗原，正常值：＜4ng/ml，暂排除前列腺癌），结合患者的病史、临床表现和相关检查，应诊断为前列腺增生，经尿道前列腺切除可以马上缓解该患者的急性症状，当仅在巨大的前列腺或有合并巨大膀胱结石者选用，多采用耻骨上经膀胱或耻骨后前列腺切除术（B对C错）。5α还原酶抑制剂（A错）通过阻止睾酮转变为有活性的双氢睾酮，进而使前列腺体积部分缩小，改善排尿症状。但一般在服药3个月左右见效，不能缓解急性症状。患者无尿路感染（无尿痛、尿常规正常），不选抗感染（D错）。α受体阻滞剂（E错）能有效降低前列腺平滑肌张力，减少尿道阻力，改善排尿功能。